宜于餐后服用的药品是
A. 呋塞米
B. 普伐他汀
C. 甲氧氯普胺
D. 格列美脲
E. 阿司匹林

正确答案：E。阿司匹林

解析：本题考查药品服用的适宜时间。阿司匹林（E对）为非甾体抗炎药，宜于餐后服用。呋塞米（A错）为利尿药，宜于清晨服用。普伐他汀（B错）为调节血脂药，宜于睡前服用。甲氧氯普胺（C错）为促胃动力药，宜于餐前服用。格列美脲（D错）为降糖药，宜于餐中服用。